甲、乙乡某病的粗死亡率相等，经过年龄标化后，甲乡标化死亡率＞乙乡，其原因可能有
A. 甲乡老人比重＞乙乡
B. 甲乡老人比重＜乙乡
C. 与年龄构成无关
D. 甲乡女性人口数＞乙乡
E. 甲乡诊断比乙乡更准确

正确答案：B。甲乡老人比重＜乙乡

解析：本题考查死亡率的相关内容。死亡率表示在一定期间内，某人群中总死亡人数在该人群中所占的比例。其分子为死亡人数，分母为该人群同期平均人口数。甲、乙乡某病的粗死亡率相等，经过年龄标化后，甲乡标化死亡率＞乙乡，其原因可能是甲乡老人比重＜乙乡（B对ACDE错）。